老年人个人口腔卫生注重
A. 刷牙与漱口
B. 及时修复缺失牙
C. 定期进行口腔检查
D. 使用间隙刷、牙线和牙签
E. 以上说法均正确

正确答案：E。以上说法均正确

解析：本题考查老年人口腔保健。老年人个人口腔卫生注重：①刷牙与漱口（A对）；②使用间隙刷、牙线和牙签（D对）；③定期进行口腔检查（C对）；④及时修复缺失牙（B对）。以上说法均对，选E。